胎儿生长受限是指
A. 孕37周后，胎儿出生体重小于3000g
B. 孕42周后，胎儿出生体重小于2500g
C. 孕37周后，胎儿出生体重小于2000g
D. 孕37周后，胎儿出生体重小于2500g
E. 孕42周后，胎儿出生体重小于2000g

正确答案：D。孕37周后，胎儿出生体重小于2500g

解析：胎儿生长受限是由于病理原因造成的出生体重低于同孕龄同性别胎儿平均体重的两个标准差或第10百分位数，或足月胎儿出生体重小于2500g，实质是胎儿的生长未能达到其潜在应有的生长速率（D对）。